管理办法由国务院发布的是
A. 精神药品
B. 戒毒药品
C. 两者均是
D. 两者均不是

正确答案：C。两者均是

解析：本题考查特殊管理药品。管理办法由国务院发布的是麻醉药品、精神药品、医疗用毒性药品（C对）、放射性药品。根据《中华人民共和国药品管理法》第三十五条，国家对麻醉药品、精神药品、医疗用毒性药品、放射性药品，实行特殊管理。管理办法由国务院制定。